在人的生命活动中，起主导作用的是
A. 运动系
B. 消化系与呼吸系
C. 泌尿系与生殖系
D. 神经系统
E. 感觉器与脉管系

正确答案：D。神经系统

解析：在人的生命活动中，起主导作用的是神经系统（D对），人体内各系统器官在神经系统的协调控制下，完成统一的生理功能。